心力衰竭药的常规联合用药方案是
A. β受体阻断剂+利尿药+血管紧张素转换酶抑制剂
B. 利尿剂+钙通道阻滞剂+β受体阻断剂
C. 利尿剂+α受体阻断剂+β受体阻断剂
D. 利尿剂+钙通道阻滞剂+强心苷
E. 利尿剂+β受体阻断剂+强心苷

正确答案：A。β受体阻断剂+利尿药+血管紧张素转换酶抑制剂

解析：本题考查药物的联合应用。心力衰竭药的常规联合用药方案是β受体阻断剂+利尿药+血管紧张素转换酶抑制剂（A对）。心力衰竭的治疗分为病因治疗和消除诱因，可用利尿剂、肾素-血管紧张素-醛固酮系统（RAAS）抑制剂、β受体阻断剂及正性肌力药物按需联合用药。